女，46岁。劳力性心慌，伴恶心、呕吐，食欲缺乏，水肿。可能还会有下列哪些症状
A. 夜间阵发性呼吸困难
B. 急性肺水肿
C. 肝淤血
D. 肾衰竭
E. 肺淤血

正确答案：C。肝淤血

解析：患者中年女性，有劳力性心慌并伴恶心、呕吐，食欲缺乏，水肿（右心衰竭常见表现）等症状，考虑诊断为右心衰竭，因此可能还会有肝淤血（C对）症状。夜间阵发性呼吸困难（A错）和肺淤血（E错）常见于左心衰竭（P166）。急性肺水肿（B错）常由急性左心衰竭（P174-P175）引起，其典型表现为强迫坐位、面色灰白、发绀，同时频繁咳嗽，咳粉红色泡沫状痰。肾衰竭（P520）（D错）可有乏力、腰酸、夜尿增多等不适，而且多伴有水和电解质代谢紊乱。